下述机构中的医师不适用执业医师法的是
A. 计划生育技术服务机构
B. 药品生产经营机构
C. 医疗机构
D. 预防机构
E. 保健机构

正确答案：B。药品生产经营机构